1956年美国学者提出的医患关系基本模式是
A. 主动-被动型，互相-合作型，平等参与型
B. 主动-合作型，相互-指导型，共同参与型
C. 主动-配合型，指导-合作型，共同参与型
D. 主动-被动型，指导-合作型，共同参与型
E. 主动-被动型，共同参与型，父权主义型

正确答案：D。主动-被动型，指导-合作型，共同参与型

解析：萨斯-荷伦德模式。这是美国学者萨斯荷伦德于1976年在《医学道德问题》上发表的题为关于《医生-病人关系的基本模式》的文章中提出的三种不同模式，是依据在医疗措施的决定和执行中医生和病人各采取主动性大小确定的。其具体模式为：①主动-被动型。主动-被动型是在目前仍被普遍接受的模式。这种模式是指在医疗过程中，医生的权威性得到充分的肯定，处于主动地位：病人处于被动地位，并以服务为前提。②指导-合作型，它是广泛存在的一种医患关系。医患双方在医疗活动中都是主动的，但医生主动性大于病人，医生起主导作用。③共同参与型。共同参与型是指在医疗过程中，医生和病人具有近似同等的权利，共同参与医疗的决定和实施（D对）。